哪种疾病用青霉素治疗可引起赫氏反应
A. 流行性脑脊髓膜炎
B. 草绿色链球菌心内膜炎
C. 大叶性肺炎
D. 气性坏疽
E. 梅毒

正确答案：E。梅毒